下列不属于宫颈癌相关危险因素的是
A. 多个性伴侣
B. 吸烟
C. 未生育
D. 不洁性行为
E. 过早性生活

正确答案：C。未生育

解析：宫颈癌相关危险因素同子宫颈上皮内瘤变，包括①HPV感染、②多个性伴侣（A对）、③不洁性行为（D对）、④过早性生活（初次性生活＜16岁）（E对）、⑤吸烟（B对）。未生育（C错，为本题正确答案）不是宫颈癌的危险因素。